拟减少过多的白细胞
A. 骨髓移植
B. Ara﹣C
C. 白细胞单采
D. 羟基脲
E. 干扰素

正确答案：C。白细胞单采

解析：白细胞单采能够减少过多的白细胞，对高白细胞血证进行有效处理（C对）。骨髓移植为造血干细胞移植，与拟减少白细胞无关，不合题意（A错）。Ara-c（阿糖胞苷）为化疗药物，诱导细胞凋亡，不合题意（B错）。羟基脲为细胞周期性化疗药，用药后二三天出现白细胞数下降，停药后又很快回升，不合题意（D错）。干扰素为诱导细胞凋亡药物，与题意不合（E错）